雌激素受体阳性的乳癌在根治术后最常用的激素治疗方法是
A. 卵巢切除
B. 口服三苯氧胺
C. 口服甲地孕酮
D. 肌注丙酸睾丸酮
E. 口服泼尼松

正确答案：B。口服三苯氧胺

解析：乳腺癌细胞中雌激素受体阳性者，称激素依赖性肿瘤，这些病例对内分泌治疗敏感。三苯氧胺又称他莫昔芬，其结构式与雌激素相似，可在靶器官内与雌二醇争夺雌激素受体，三苯氧胺-ER复合物能影响DNA的基因转录，从而抑制肿瘤细胞生长。因此，口服三苯氧胺（B对）为雌激素受体阳性的乳癌在根治术后最常用的激素治疗方法，有效率约为55%～60%。甲地孕酮（C错）由于具有抗雌激素活性，近来也用于乳腺癌的姑息治疗，有效率约10%～15%。肌注丙酸睾丸酮（D错）用于绝经期后女性晚期乳腺癌的姑息性治疗。口服泼尼松（E错）不属于乳癌的激素治疗方法。卵巢切除（A错）用于治疗晚期乳腺癌和复发性乳腺癌。